在测量基础代谢率时，正确的做法是
A. 室温不限高低，但要求恒定不变
B. 测量前一天晚上的饮食不受任何限制
C. 测量可在24小时内任何时刻进行
D. 受试者无精神紧张和肌肉活动
E. 受试者应处于睡眠状态

正确答案：D。受试者无精神紧张和肌肉活动